在采用Cox回归模型对肝癌患者术后随访资料进行分析时，哪种情况不能当作截尾值处理
A. 死于肝癌及其并发症
B. 意外死亡
C. 死于其他肿瘤
D. 死于心脏病
E. 失访

正确答案：A。死于肝癌及其并发症

解析：本题考查截尾数据的原因。截尾数据产生原因包括：失访（E对）、退出，即患者死于其他疾病或因其他原因死亡（如死于意外（B对）、其他肿瘤（C对）、心脏病（D对））而终止观察、终止。死于肝癌及其并发症（A错，为本题正确答案）不能作为截断值。